下列哪一项是深部脓肿的特征性表现
A. 发热
B. 波动感
C. 局部淋巴结肿大
D. 凹陷性水肿
E. 白细胞总数增高，中性粒细胞比例上升

正确答案：D。凹陷性水肿

解析：本题考查深部脓肿的特征性表现。口腔颌面部感染的深部脓肿，一般很难查到波动感（B错），凹陷性水肿是深部脓肿的特征性表现（D对）。波动试验是临床上诊断浅部脓肿的主要方法。发热是严重感染出现全身症状后的一般表现（A错）。局部淋巴结肿大是淋巴结炎或恶性肿瘤转移的临床表现（C错）。白细胞总数增高，中性粒细胞比例上升是细菌感染的病理表现（E错）。